男性，60岁，主诉左下后牙咀嚼疼痛。口腔检查：左下第一磨牙牙体无明显病变，颊侧牙周袋深6mm，牙龈退缩可见根分叉区完全开放，探针能水平通过分叉区，X线片示：根分叉区完全开放。按Glickman根分叉病变分度法，此根分叉病变属于
A. Ⅰ度
B. Ⅱ度
C. Ⅲ度
D. Ⅳ度
E. 正常

正确答案：D。Ⅳ度

解析：本题考查Glickman根分叉病变分度法。患者检查可见左下第一磨牙牙体无明显病变，颊侧牙周袋深6mm，牙龈退缩可见根分叉区完全开放（根间骨隔完全破坏），探针能水平通过分叉区（与对侧贯通），X线片示：根分叉区完全开放（可见完全的透影区）。按Glickman根分叉病变分度法，此根分叉病变属于Ⅳ度（D对）。Glickman根分叉病变分度：Ⅰ度（A错）属于病变早期，根分叉区的骨质吸收很轻微，从牙周袋内已能探到根分叉的外形，但不能水平探入分叉内，通常在X线片上看不到改变。Ⅱ度（B错）在多根牙的一个或一个以上的分叉区内已有骨吸收，但尚未与对侧相通，用牙周探针或弯探针可从水平方向部分地进入分叉区内，X线片一般显示分叉区有局限的牙周膜增宽，或骨质密度有小范围的降低。Ⅲ度（C错）根分叉区的牙槽骨全部吸收，形成“贯通性”病变，探针能水平贯通分叉区，但仍被牙周袋软组织覆盖而未直接暴露于口腔，下颌磨牙的Ⅲ度病变在X线片上可见完全的透影区。Ⅳ度：根间骨隔完全破坏，且牙龈退缩而使病变的根分叉区直接暴露于口腔。正常（E错）不会出现牙龈退缩，根分叉区暴露的情况。